幼儿用于生长发育的热能需要占总热能的比例大致为
A. 15%～16%
B. 13%～15%
C. 12%～14%
D. 11%～13%
E. 10%～12%

正确答案：A。15%～16%

解析：本题考查生长发育的热能需要。生长所需是指儿童特有的能量消耗，所需能量与生长速度成正比。例如婴儿生长最快，此项所需约占总能量的25%～30%；幼儿期以后生长减缓，至学龄前儿童约为15%～16%（A对CDE错）；学龄初期儿童约占10%；青春发育期少年生长加速则又增高至13%～15%（B错）。如果饮食所供能量不能满足这些需要，生长发育就会减缓，甚至停顿。